腻苔的特点是
A. 颗粒细腻，刮之难去
B. 颗粒较大，刮之难去
C. 颗粒细腻，刮之易脱
D. 滑利而湿，刮之易脱
E. 色白质厚，刮之易脱

正确答案：A。颗粒细腻，刮之难去

解析：本题考查的是望舌苔的主要内容及临床意义。腻苔的特点是颗粒细腻，刮之难去（A对）。腻腐：腻苔，是舌面上覆盖着一层浊而滑腻的苔垢，颗粒细腻而致密，刮之难去，多见于湿浊、痰饮、食积等阳气被阴邪所抑的病变，如痰饮、湿温等病证。腐苔，苔质颗粒较大，松软而厚，形如豆腐渣堆积舌面，刮之易脱（BC错），多由阳热有余、蒸腾胃中腐浊邪气上升而成，常见于食积、痰浊等病。滑利而湿，刮之易脱（D错）为滑苔，多是水湿内停之征。色白质厚，刮之易脱（E错）为白厚苔。